红细胞代偿性增多的病因是
A. 营养不足
B. 红细胞生成相对不足
C. 消耗增加
D. 骨髓造血容量减少
E. 血浆容量增高，血液被稀释

正确答案：C。消耗增加